拔除7|7的最佳麻醉方法是
A. 颊、腭侧局部浸润
B. 颊侧近中局部浸润颊上颌结节麻醉，腭侧行腭大孔麻醉
C. 颊侧行上颌结节阻滞麻醉，腭侧行局部浸润
D. 颊侧行上颌结节阻滞麻醉，腭侧行腭大孔麻醉
E. 颊侧行眶下孔阻滞麻醉，腭侧行腭大孔麻醉

正确答案：D。颊侧行上颌结节阻滞麻醉，腭侧行腭大孔麻醉

解析：本题考查上、下颌神经在口腔的分布。拔除7|7的最佳麻醉方法是颊侧行上颌结节阻滞麻醉，腭侧行腭大孔麻醉（D对）。7|7主要受腭前神经（腭侧黏骨膜及牙龈）和上牙槽后神经（牙髓）支配，需在颊侧行上颌结节阻滞麻醉，腭侧行腭大孔麻醉。